在石棉厂工作35年的52岁男性病人，10年前患者出现咳嗽，活动时呼吸困难加剧，常伴局部胸痛。咳痰量不多，痰中查出石棉小体，肺活量降低，X光胸片有不规则小阴影和胸膜改变，肺纹理改变及肺气肿。近几月发现一侧胸壁显现不规则突起，沿胸外侧壁胸膜自下而上生长，再沿胸内侧延伸，该工人可能患的是
A. 肺癌、肺气肿
B. 石棉肺、胸膜炎
C. 硅酸盐肺、肺腺癌
D. 石棉肺、胸膜间皮瘤
E. 石棉肺、肺鳞癌

正确答案：D。石棉肺、胸膜间皮瘤